治疗湿热淋证，宜选用
A. 石韦
B. 大青叶
C. 板蓝根
D. 青黛
E. 山豆根

正确答案：A。石韦

解析：石韦为利尿通淋药，具有利尿通淋，清肺止咳，凉血止血的功效，药性寒凉，清利膀胱而通淋，可治疗湿热淋证（A对）。大青叶为清热解毒药，具有清热解毒，凉血消斑的功效，不能治疗淋证（B错）。板蓝根为清热解毒药，具有清热解毒，凉血，利咽的功效，不能治疗淋证（C错）。青黛为清热解毒药，具有清热解毒，凉血消斑，清肝泻火，定惊的功效，不能治疗淋证（D错）。山豆根为清热解毒药，具有清热解毒，利咽消肿的功效，不能治疗淋证（E错）。